流脑的主要防治措施为
A. 注射疫苗
B. 流行期间避免大型聚会
C. 抗生素
D. A+C
E. A+B+C

正确答案：E。A+B+C